均数作为一种统计指标是用来分析
A. 调查资料
B. 定量资料
C. 等级分组资料
D. 分类资料
E. 计数资料

正确答案：B。定量资料

解析：算术均数：简称均数，它是一组变量值之和除以变量值个数所得的商。适用于呈正态或近似正态分布的定量资料。掌握“定量资料的统计描述和推断”知识点。